关于上颌第一乳磨牙的解剖特点说法，错误的一项是
A. 颊面的宽度大于长度，近中缘长直，远中缘短突，颈部缩窄
B. 颊尖微突，略偏近中
C. 邻面可见其1/3显著缩窄，颊侧颈1/3处非常突出
D. （牙合）面形态似上颌前磨牙
E. 牙根细长，三根分叉大，根干较长

正确答案：E。牙根细长，三根分叉大，根干较长

解析：本题考查上颌第一乳磨牙的解剖特点。牙根细长，三根分叉大，根干较长（E错，为本题正确答案）不符合上颌第一乳磨牙的解剖特点。上颌第一乳磨牙的牙根细长，分为三根。根干较短，根分叉接近牙颈部，根分叉大，以保护其间的恒牙胚。颊面似梯形，近远中径宽度大于牙合颈高度，近中缘长直，远中缘短突，牙颈缩窄（A对）,故颈嵴很突，近中部分尤为突出。颊尖微突，略偏近中（B对）。舌面较颊面小且圆突，舌尖较颊尖圆突。邻面可见其牙合1/3明显缩窄，颊侧颈1/3处非常突出（C对）。牙合面形态似上颌前磨牙（D对），但牙合面颊舌尖的三角嵴及沟的形态均不如上颌前磨牙清晰。